以上不属于对牙髓疾病、根尖周疾病的应急处理的是
A. 牙髓摘除术
B. 切开排脓术
C. 开髓引流术
D. 根尖诱导成形术
E. 消炎止痛、适当调（牙合）

正确答案：D。根尖诱导成形术

解析：根尖诱导成形术是针对年轻恒牙牙髓病的处理，而不属于针对牙髓疾病的应急处理。掌握“急症处理”知识点。